小脑绒球小结叶受损后的表现是
A. 运动编程功能受损
B. 运动启动功能障碍
C. 肌肉精细运动受损
D. 身体平衡功能障碍
E. 运动协调功能受损

正确答案：D。身体平衡功能障碍

解析：小脑的中央为小脑蚓部，两侧为小脑半球。根据小脑表面的沟和裂，小脑分为三个主叶，即绒球小结叶、前叶和后叶。绒球小结叶主要接受来自前庭核和前庭神经的传入纤维，调节躯干肌肉的活动，在维持肌紧张、身体平衡和姿势等方面起重要作用，受损时可表现为身体平衡功能障碍（D对）；肌肉精细运动受损（C错）见于前叶的蚓部及后叶蚓部的后外侧部（其主要功能是与头部和身体的本体感受和外感受的传入信息有关，有调节肌紧张的作用）；运动协调功能受损（E错）见于小脑半球大部分和部分蚓部（其主要接受经脑桥接转的来自大脑皮质的纤维，参与由大脑皮层发起的随意运动的调节）。运动编程功能受损（A错）见于小脑皮层的外侧区和齿状核（其通过其与大脑皮层之间的交互联系，在随意运动发生的早期与大脑皮层联络区、基底神经节、丘脑腹外侧核等神经结构一起，参加了随意运动的设计和运动程序的编制）；运动启动功能障碍（B错）见于小脑皮层的间位区和间位核（其参加了随意运动的执行）。